选择避孕方法的原则不正确的是
A. 生殖器炎症不宜使用宫内节育器
B. 糖尿病以自然避孕为宜
C. 新婚夫妇可常规使用紧急避孕方法
D. 患肝肾疾病者宜使用避孕套
E. 月经过少或闭经者，不宜使用避孕药

正确答案：C。新婚夫妇可常规使用紧急避孕方法

解析：本题考查常用的避孕方法。新婚夫妇不可常规使用紧急避孕方法（C错，为本题正确答案），紧急避孕不是常规避孕方法，紧急避孕失败率可达2%，故使用后应采取可靠的常规避孕措施，不宜反复使用。生殖器炎症不宜使用宫内节育器（A对）；糖尿病以自然避孕为宜（B对）；患肝肾疾病者宜使用避孕套（C对）；月经过少或闭经者，不宜使用避孕药（D对）。